弥漫性膜性增生性肾小球肾炎时，增生的细胞主要是
A. 肾小球脏层细胞和中性粒细胞
B. 肾小球壁层细胞和系膜细胞
C. 肾小球系膜细胞和基质
D. 肾小球的系膜细胞和系膜基质高度增生
E. 肾小球各种细胞均有明显增生

正确答案：D。肾小球的系膜细胞和系膜基质高度增生

解析：弥漫性膜性增生性肾小球肾炎的病变特点是肾小球毛细血管基底膜增厚和系膜细胞增生（D对）。肾小球系膜细胞和基质（C错）增生是系膜增生性肾小球肾炎（P272）的病变特点。壁层上皮细胞增生（B错）是急进性肾小球肾炎（P267）的病变特点。